不属于疾病监测目的的是
A. 确定主要的健康问题，掌握其分布和趋势
B. 查明原因，采取干预措施
C. 评价干预措施效果
D. 预测疾病流行
E. 尽量提供信息和资源

正确答案：E。尽量提供信息和资源

解析：疾病监测的目的：①确定主要的健康问题，掌握其分布和趋势；②查明原因，采取干预措施；③评价干预措施效果；④预测疾病流行；⑤制订公共卫生策略和措施。掌握“流行病的诊断和筛检试验及疾病监测”知识点。